患者突发咳嗽，咳痰黄稠，进而咳铁锈色痰，呼吸气促，高热不退，胸膈痞满，按之疼痛，口渴烦躁，小便黄赤，大便干燥，舌红苔黄，脉洪数或滑数。其治法宜选
A. 疏风清热，宣肺止咳
B. 清热化痰，宽胸止咳
C. 清热解毒，化痰开窍
D. 益气养阴，润肺化痰
E. 解表散寒，清泄里热

正确答案：B。清热化痰，宽胸止咳

解析：本题患者为肺炎，痰热蕴结于肺，肺失清肃而气上逆，则咳喘，呼吸气促，咳痰黄稠；阻滞肺络，壅滞气血，则咳铁锈色痰，胸膈痞满，按之疼痛。热盛伤津则口渴烦躁，高烧不退，小便黄赤，大便干燥。舌红苔黄，脉洪数或滑数，为痰热内盛之象，宜清热化痰，宽胸止咳（B对）；疏风清热，宣肺止咳用于邪犯肺卫证，症状：发病初起，咳嗽，咳痰不爽，痰色白或黏稠色黄，发热重，恶寒轻，无汗或少汗，口微渴，头痛，鼻塞，舌边尖红，苔薄白或微黄，脉浮数（A错）；清热解毒，化痰开窍用于热闭心包证，症状：咳嗽气促，痰声辘辘，烦躁，神昏谵语，高热不退，甚则四肢厥冷，舌红绛，苔黄而干，脉细滑数（C错）；益气养阴，润肺化痰用于正虚邪恋证，症状：干咳少痰，咳嗽声低，气短神疲，身热，手足心热，自汗或盗汗，心胸烦闷，口渴欲饮，或虚烦不眠，舌红，苔薄黄，脉细数（D错）；解表散寒，清泄里热用于外感风寒，内有蓄热证，症状：发热，恶风寒，身疼痛，无汗，烦躁，咳嗽，或气喘，或渴，苔白或兼薄黄，脉浮紧（E错）。